检测他汀类药物所致肌毒性的临床指标是
A. 乳酸脱氢酶
B. 尿淀粉酶
C. 碱性磷酸酶
D. 肌酸激酶
E. γ-谷氨酸转移酶

正确答案：D。肌酸激酶

解析：本题考查他汀类药物的不良反应。他汀类药物属调节血脂药。调节血脂药具有肝毒性、肌毒性，长期服用者有2%可发生肝损伤，表现为无症状性、肝脏转氨酶ALT及AST一过性升高，约有0.01%可发生横纹肌溶解症和急性肾衰竭。因此，服用者应定期检测肝功能和肌磷酸激酶（D对），长期服药者应当3～6个月检测1次，调整药物剂量者应当1～2个月监测1次。